当红细胞渗透脆性增大时
A. 红细胞不易破裂
B. 对高渗盐溶液抵抗力增大
C. 对高渗盐溶液抵抗力减小
D. 对低渗盐溶液抵抗力减小
E. 对低渗盐溶液抵抗力增大

正确答案：D。对低渗盐溶液抵抗力减小